关于噻嗪类利尿药，叙述错误的是
A. 痛风患者慎用
B. 糖尿病患者慎用
C. 可引起低钙血症
D. 肾衰竭者禁用
E. 可引起血氨升高

正确答案：C。可引起低钙血症

解析：本题考查噻嗪类利尿药。关于噻嗪类利尿药，叙述错误的是可引起低钙血症（C错，为本题正确答案）。氢氯噻嗪的不良反应：1.电解质紊乱，表现为：①低钾血症；②低氯性碱中毒或低氯、低钾性碱中毒；③低钠血症；④脱水造成血容量和肾血流量减少亦可引起肾小球滤过率降低；⑤升高血氨（E对）；⑥高钙血症；⑦高尿酸血症；⑧血磷、镁及尿钙降低。2.升高血糖。3.升高血脂。4.性功能减退。5.噻嗪类利尿药可引起中枢神经系统（如眩晕、头痛）、胃肠道、血液系统（白细胞减少、血小板减少等）和皮肤反应（如光敏反应和皮疹）等不良反应。噻嗪类利尿药禁用于对本类药或含有磺酰胺基团药过敏者、痛风患者（A对）、低钾血症者、无尿或肾衰竭者（D对）。以下情况慎用：糖尿病（B对）、高尿酸血症或痛风、高钙血症、低钠血症、系统性红斑狼疮、胰腺炎、交感神经切除者、婴儿黄疽、哺乳期妇女。